下列哪项不是咀嚼黏膜的特征
A. 有角化层
B. 颗粒层不明显
C. 上皮钉突多而细长
D. 固有层较厚
E. 胶原纤维粗大

正确答案：B。颗粒层不明显

解析：本题考查口腔黏膜基本结构。颗粒层不明显（B错，为本题正确答案）不是咀嚼黏膜的特征。咀嚼黏膜包括硬腭和牙龈黏膜，承受咀嚼压力，特点是上皮较厚，上皮表层有正角化或不全角化（A对），有粒层，细胞间隙宽并见细胞间桥；固有层厚（D对），胶原纤维粗大（E对），排列紧密呈网状，固有层的乳头多而长，与上皮钉突呈指状镶嵌，上皮钉突多而细长（C对），形成良好的机械附着，可有效地防止上皮在外力作用下与下面的结缔组织分开。咀嚼黏膜或借固有层直接附在骨膜上，形成黏骨膜或借黏膜下层与骨膜相连。